外用能清热收敛的药是
A. 滑石
B. 血竭
C. 硼砂
D. 车前子
E. 地肤子

正确答案：A。滑石

解析：本题考查的是滑石的功效。外用能清热收敛的药是滑石（A对）。滑石：【功效】利尿通淋，清解暑热；外用清热收湿敛疮。血竭（B错）：【功效】活血定痛，化瘀止血，生肌敛疮。硼砂（C错）：【功效】外用清热解毒，内服清肺化痰。车前子（D错）：【功效】利水通淋，渗湿止泻，明目，清肺化痰。地肤子（E错）：【功效】利尿通淋，祛风止痒。